一食堂，就餐者用餐1小时后，陆续出现唇指甲以及全身皮肤青紫等症状。你采取何种措施进行急救
A. 洗胃，倒泻
B. 洗胃，倒泻，灌肠
C. 静脉注射维生素
D. 静脉注射亚甲蓝
E. 洗胃，灌肠，静脉注射维生素C和亚甲蓝

正确答案：E。洗胃，灌肠，静脉注射维生素C和亚甲蓝

解析：本题为集体性食物中毒，就餐者食入1小时后陆续出现唇、指甲及全身皮肤青紫等症状即出现发绀表现，最可能的原因是误食亚硝酸盐后，血红蛋白中二价铁被氧化成三价铁导致血中高铁血红蛋白增多，引起“肠源性发绀”，患者可出现唇、指甲以及全身皮肤青紫等症状，因此本例最可能的中毒原因为亚硝酸盐中毒。亚硝酸盐中毒治疗措施为恢复血红蛋白的运氧能力，同时减少毒物的进一步吸收。洗胃、导泻、静脉注射维生素C和亚甲蓝（E对）治疗措施最全面。